沉淀滴定法使用的滴定液是
A. 氢氧化钠滴定液
B. 甲醇钠滴定液
C. 碘滴定液
D. 硝酸银滴定液
E. 乙二胺四醋酸二钠滴定液

正确答案：D。硝酸银滴定液